用酸度计测定溶液的pH值，测定前应用pH值与供试液较接近的一种标准缓冲液，调节仪器旋钮，使仪器pH示值与标准缓冲液的pH值一致，此操作步骤称为
A. 调节零点
B. 校正温度
C. 调节斜率
D. 平衡
E. 定位

正确答案：E。定位